夜间阵发性呼吸困难，可见于
A. 急性脑血管疾病
B. 癔症
C. 急性感染所致的毒血症
D. 慢性阻塞性肺气肿
E. 左心功能不全

正确答案：E。左心功能不全

解析：呼吸困难是指患者主观上感到空气不足，呼吸费力；客观上表现为呼吸频率、节律与深度的异常。左心功能不全（E对）时，因急性肺淤血常出现阵发性呼吸困难，多在夜间入睡后感到气闷而被憋醒，称为夜间阵发性呼吸困难，发作时，患者被迫坐起喘气和咳嗽，轻者数十分钟后症状消失，重者表现为面色青紫、大汗、呼吸有哮鸣音，咳粉红色泡沫状痰。急性脑血管疾病（A错）的呼吸常变慢而深，并有呼吸节律的异常，如呼吸遏止、双吸气等。癔症（B错）可有呼吸困难的发作，其特点是呼吸非常频速和表浅，并常因换气过度而发生呼吸性碱中毒，出现口周、肢体麻木和手足抽搐。急性感染所致的毒血症（C错）由于机体代谢增加、体温增高及毒性代谢产物刺激呼吸中枢使呼吸加快。慢性阻塞性肺气肿（D错）表现为呼气性呼吸困难，呼气显著费力，呼气时间延长而缓慢。